哪项与肾藏精有关
A. 面色红润
B. 肌肉丰满
C. 视物清晰
D. 皮毛润泽
E. 头发乌黑光泽

正确答案：E。头发乌黑光泽

解析：头发为肾之外候，肾精的盛衰可显露于头发，由于肾藏精，精生血，精血旺盛，则毛发粗壮、浓密而润泽，故说发的生机根于肾（E对）。面色红润，《素问·六节脏象论》说：“心，其华在面。”心气旺盛，血脉充盈，则面部红润光泽（A错）。《素问·痿论》说：“脾主身之肌肉”。脾的运化功能正常，水谷精微充足，肌肉才会丰满壮实（B错）。肝，在窍为目，肝血充足，肝气调和，两目视物清晰（C错）。肺，在体合皮，其华在毛，皮毛依赖于卫气和津液的温养和润泽（D错）。